男，50岁。颈后肿痛5天，疼痛逐渐加重，伴畏寒、发热。有糖尿病史10年。查体：颈后红肿，范围约5cm，边界不清，中央多个脓点。若行切开引流术，下列错误的处理措施是
A. 未化脓但颜色已暗紫的组织也要清除
B. 可行“++”形切口切开引流
C. 切口线不宜超过病变边缘
D. 切口线要深达筋膜
E. 创面内填塞敷料压迫止血

正确答案：C。切口线不宜超过病变边缘

解析：患者为中老年男性，有糖尿病史，畏寒发热，颈后红肿，范围较大，中央多个脓点，应诊断为颈部痈（糖尿病患者由于抗感染能力降低，易发生痈。痈好发于颈部，表现为红、肿、热、痛，中间可有脓点）。在切开引流时，在静脉麻醉下作“+”或“++”形切开引流（B对），切口线应超过病变边缘皮肤（C错，为本题正确答案），深度应深达筋膜或筋膜下（D对），切断所有纤维间隔，尽量清除所有坏死组织。清除未化脓但颜色已暗紫的组织（尚未成脓、但已失活）（A对），然后在创面内填塞敷料压迫止血（E对）（脓腔内填塞生理盐水或凡士林纱条），外加纱布绷带包扎。